治出血过多所致气虚欲脱者，如单用止血药，则缓不济急，应急予
A. 收涩药
B. 补血药
C. 补阴药
D. 补脾药
E. 大补元气药

正确答案：E。大补元气药

解析：本题考查的是止血药临床应用。治出血过多所致气虚欲脱者，如单用止血药，则缓不济急，应急予大补元气药（E对）。凡以制止机体内外出血为主要功效的药物，称为止血药。临床应用时，血热妄行者，配清热凉血药；阴虚阳亢者，配滋阴潜阳药；瘀血阻滞而出血者，配活血行气药；虚寒性出血者，应根据病情配温阳、益气、健脾等药。出血过多而致气虚欲脱者，如单用止血药，则缓不济急，应急予大补元气之药，以益气固脱。收涩药（A错）是指以收敛固涩为主要功效的药物。亦称收敛药或固涩药。本类药适用于久病体虚、正气不固所致的自汗、盗汗、久泻、久痢、遗精、滑精、遗尿、尿频、久咳、虚喘，以及崩带不止等滑脱不禁之证。补血药（B错）与补阴药（C错）属于补虚药。补虚药，习称补益药或补养药，是指凡能补充人体物质亏损、增强人体功能活动，以提高抗病能力、消除虚弱证候为主要功效的药物。按其性能功效和临床应用，常将本类药物分为补气药、补阳药、补血药、补阴药四类。其中，补气药功主补气以增强脏腑功能活动，主治气虚诸证。补阳药功主温补人体之阳气，主治阳虚诸证。补血药功主养血，兼能滋阴，主治血虚、阴血亏虚等证。补阴药功主滋阴补液，兼能润燥，主治阴液亏虚诸证。补脾（D错）为人参、白术、山药、饴糖、菟丝子、黄精、莲子肉、芡实等的功效。